能产生神经毒素的痢疾杆菌是
A. 志贺痢疾杆菌
B. 福氏痢疾杆菌
C. 舒密次痢疾杆菌
D. 鲍氏痢疾杆菌
E. 宋内痢疾杆菌

正确答案：A。志贺痢疾杆菌

解析：所有痢疾杆菌均可产生内毒素，引起全身严重反应如发热、毒血症及休克等。外毒素亦称志贺毒素（A对BCDE错），具有肠毒性、神经毒性、细胞毒性，引起相应的临床表现。福氏志贺菌感染易转为慢性，宋氏志贺菌感染多为不典型发作，痢疾志贺菌毒力最强，临床症状较严重。